药师应主动向患者做出提示的是
A. 患者在使用既往安全的单一药品时
B. 患者在使用用法十分简单的药品时
C. 患者在按疗程使用治疗药品时
D. 患者在使用由医护督导应用的药品时
E. 患者所用药品近期发现严重不良反应时

正确答案：E。患者所用药品近期发现严重不良反应时

解析：本题考查药师的执业规范。药师应主动向患者做出提示的是患者所用药品近期发现严重不良反应时（E对）。当患者所使用的药物近期发生不良反应时，药师应主动向患者提供咨询。患者在使用既往安全的单一药品时（A错）、患者在使用用法十分简单的药品时（B错）、患者在按疗程使用治疗药品时（C错）、患者在使用由医护督导应用的药品时（D错）无需药师主动向患者做出提示。